窄谱抗菌药是
A. 头孢菌素
B. 氯霉素
C. 磺胺嘧啶
D. 异烟肼
E. 庆大霉素

正确答案：D。异烟肼

解析：本题考查窄谱抗菌药。异烟肼（D对）为抗结核分枝杆菌药物，是第一线抗结核药，其可抑制分枝菌酸的合成，从而使细胞丧失耐酸性、疏水性和增值力而死亡，而分枝菌酸是结核分枝杆菌细胞壁的重要成分，且是分枝杆菌的专有成分，因此，异烟肼选择性抗结核分枝杆菌而对其它微生物几乎无作用，是窄谱抗菌药。头孢菌素（A错）类药物可与细菌细胞内膜上主要的青霉素结合蛋白结合，使细菌细胞壁合成过程中的交叉连接不能形成，导致细菌细胞壁合成障碍，细菌溶菌死亡，其对处于繁殖期正大量合成细胞壁的细菌作用强，而对已合成细胞壁、处于静止期者作用弱，故属于繁殖期杀菌剂。氯霉素（B错）为酰胺醇类抗菌药物，主要为抑菌剂，通过抑制细菌蛋白质的合成发挥抗菌作用。磺胺嘧啶（C错）为磺胺类抗菌药，只能抑制细菌增殖，主要通过干扰叶酸代谢而发挥抗菌作用。庆大霉素（E错）为氨基糖苷类抗菌药物，该类药物可抑制细菌蛋白质合成的全过程，同时还可影响细菌细胞膜屏障功能，导致细胞死亡，为静止期杀菌药。